下列关于真核微生物描述错误的是
A. 不易在体外生长繁殖
B. 可为多细胞微生物
C. 细胞分化完善
D. 有细胞核和各种细胞器
E. 可为单细胞微生物

正确答案：A。不易在体外生长繁殖

解析：真核细胞型微生物：真核细胞型微生物（真菌）为多细胞或单细胞微生物，其细胞分化完善，有细胞核和各种细胞器，故易在体外生长繁殖。掌握“微生物定义、分类及特点”知识点。